下列除哪项外均属于虚性闭经的病因病机
A. 肝肾不足
B. 痰湿阻滞
C. 气血虚弱.
D. 阴虚血燥
E. 脾虚血少

正确答案：B。痰湿阻滞

解析：肝肾不足则精血不足，冲任血海空虚，致虚性闭经（A对）。痰湿阻滞，流注下焦，使血流不畅，冲任阻滞，血海阻隔，经血不得下行而成实性闭经（B错，为本题正确答案）。气血虚弱，冲任血海空虚，致虚性闭经（C对）。阴虚血燥，精亏血少致冲任血海空虚发为虚性闭经（D对）。脾虚血少，冲任血海空虚，致虚性闭经（E对）。